何处损伤可伤及脊髓骶段
A. 第1腰椎
B. 第1、2骶椎
C. 第2腰椎
D. 第3腰椎
E. 第5腰椎

正确答案：A。第1腰椎

解析：根据脊髓节段于椎骨的对应顺序，骶髓、尾髓节段约平对第1腰椎，当第1腰椎（A对）损伤可伤及脊髓骶段。